诊断代谢性酸中毒的主要依据是
A. 呼吸深而快，血浆HCO₃⁻下降
B. 呼吸深而快，血浆CO₂CP上升
C. 呼吸困难，血浆HCO₃⁻上升
D. 呼吸浅而慢，血浆CO₂CP下降
E. 呼吸慢，血压高，神志昏迷

正确答案：A。呼吸深而快，血浆HCO₃⁻下降

解析：代谢性酸中毒的临床表现：代偿阶段可无症状，只有化验值改变。失代偿后，除原发病表现外，轻者可感觉头痛、乏力，心率增快，呼吸加深，胃纳不佳。呼吸增强是代谢性酸中毒的重要临床表现，重者可出现呼吸深而快（Kussmaul呼吸）、心律失常、烦躁、嗜睡、感觉迟钝，甚则引起呼吸衰竭、血压下降、昏迷，以致心力衰竭、呼吸停止。血气分析见血pH及HCO₃⁻、AB、SB下降，BE负值增加是代谢性酸中毒的典型表现。CO₂CP降低，AG＞16mmol/L，在排除呼吸因素后，可诊断代谢性酸中毒（A对）。代谢性酸中毒可见呼吸深而快，血浆CO₂CP不是上升而是下降（B错）。呼吸困难，血浆HCO₃⁻不是上升而是下降（C错）。呼吸不是浅而慢，而是深而快，血浆CO₂CP下降（D错）。呼吸不是减慢，而是深快，血压不升高，反而下降，神志昏迷（E错）。